医学人道主义在历史发展的时期中不包括的是
A. 古代朴素的医学人道主义时期
B. 现代革命的人道主义时期
C. 实行革命的人道主义时期
D. 近代医学人道主义时期
E. 现代医学人道主义时期

正确答案：B。现代革命的人道主义时期

解析：医学人道主义包括古代朴素的医学人道主义时期（A对）、实行革命的人道主义时期（C对）、近代医学人道主义时期（D对）、现代医学人道主义时期（E对），所以不包括现代革命的人道主义时期（B错，为本题正确答案）。